有关高频电磁场与微波作用的一般规律，以下哪个是错误的
A. 波长愈短生物学作用愈大
B. 穿透能力取决于频率
C. 只有被组织吸收的电磁波才能发生生物效应
D. 对机体的作用主要为器质性改变
E. 是电磁辐射的一部分

正确答案：D。对机体的作用主要为器质性改变

解析：本题考查高频电磁场和微波作用的一般规律。电磁辐射主要包括X-射线、γ-射线、紫外线、可见光、红外线、激光、微波和射频辐射（E对）。一般而言，波长短，频率高，辐射能量大的电磁辐射，作用生物体产生的效应强（A对）；反之，生物学效应作用弱。微波白内障的发病机制与功率和频率（B对）有关，低频率微波穿透能力较强，被组织吸收（C对）的能量大，主要为致热效应（D错，为本题正确答案）。